女性生殖器官中，防御外邪入侵的第一道门户是
A. 子门
B. 阴道
C. 子宫
D. 玉门
E. 阴户

正确答案：E。阴户

解析：阴户指女性外阴，是防御外邪的第一道关口，有保护女性生殖脏器的作用（E对），子门即子宫颈口，是预防外邪入侵的第二道关口，是排月经、泌带液、娩出胎儿的通道（A错），阴道和子宫为内生殖器（BC错），玉门即阴道口，是排出月经、分泌带下，也是娩出胎儿、排出恶露的关口（D错）。